气体、易挥发的药物或气雾剂的适宜给药途径是
A. 直肠给药
B. 舌下给药
C. 呼吸道给药
D. 经皮给药
E. 口服给药

正确答案：C。呼吸道给药

解析：本题考查给药途径。气体、易挥发的药物或气雾剂的适宜给药途径是呼吸道给药（C对）。气体、挥发性液体或气雾剂药物常采用呼吸道给药，经肺泡吸收，迅速入血产生疗效或在呼吸道局部发挥作用，作用短而迅速。直肠给药（A错）可避免胃肠液对药物的破坏、药物对胃肠道的刺激性，在很大程度上避免了首关效应，但吸收面积小、吸收不规则，适用于胃肠道刺激性强及小儿服药困难者。舌下给药（B错）适用于脂溶性较高、用量较小的药物，由舌下黏膜吸收，具有吸收迅速和避免首关效应的特点，但吸收面积小。经皮给药（D错）用于皮肤或黏膜表面，多数药物发挥局部作用，有的药物可发挥全身作用。口服给药（E错）为最常用的给药途径，其优点是方便、经济、安全，适用于大多数患者和药物。